关于肺的描述，错误的是
A. 肺尖超出锁骨内侧1/3段上方2.5cm
B. 右肺宽短，左肺狭长
C. 左肺前缘下份有心切迹
D. 左肺分三叶，右肺分两叶
E. 内侧面中部的凹陷称肺门

正确答案：D。左肺分三叶，右肺分两叶

解析：肺尖圆钝，伸向颈根部，超出锁骨内侧1/3段上方2.5cm（A对）。肺位于胸腔内，纵隔两侧，由于心脏位置偏左，故右肺略宽短，左肺狭长（B对）。肺有三缘：前缘，锐薄、左肺前缘下部有心切迹（C对）、切迹下方为左肺小舌；后缘，钝圆、靠脊柱；下缘，较锐、伸入膈和胸壁之间的肋膈隐窝内。左肺被斜裂分为上、下两叶，右肺被斜裂和水平裂分为上、中、下三叶（D错，为本题正确答案）。肺内侧面与纵隔相邻，其中央椭圆形凹陷称为肺门（E对）。